根面平整术的目的是
A. 去除根面感染牙骨质
B. 去除残余牙石
C. 去除袋内壁肉芽组织
D. 清除龈下菌斑
E. 以上都是

正确答案：E。以上都是

解析：本题考查龈下刮治和根面平整术。根面平整术目的在于，在做龈下刮治即用比较精细的龈下刮治器刮除位于牙周袋内根面上的牙石和菌斑时，同时去除根面感染牙骨质（A对），因感染牙骨质已被细菌侵袭无保留价值。并去除部分嵌入牙骨质内的残余牙石（B对），同时能清除龈下刮治术后残留的龈下菌斑（D对），使刮治后的根面光滑而平整，防止细菌再次附着。在刮除深牙周袋中的龈下牙石时，应同时去除袋内壁肉芽组织（C对），使牙周袋变浅或消失。（ABCD均对，故E为本题的正确答案）。